不属于人畜共患传染病的是
A. 口蹄疫
B. 猪蓝耳病
C. 猪水疱病
D. 猪瘟
E. 牛结核病

正确答案：B。猪蓝耳病

解析：本题考查人畜共患传染病。常见的人畜共患传染病主要有炭疽、鼻疽、口蹄疫（A对）、猪水庖病（C对）、猪瘟（D对）、猪丹毒、猪出血性败血症、结核病（E对）和布鲁氏菌病等。猪蓝耳病（B错，为本题正确答案）是猪的一种特定传染病，病毒不会传染给人。